清炒（单炒）时，需要炒黄法炮制的中药是
A. 芥子
B. 蒲黄
C. 大蓟
D. 荆芥
E. 枳壳

正确答案：A。芥子

解析：本题考查的是芥子的炮制方法。清炒（单炒）时，需要炒黄法炮制的中药是芥子（A对）。芥子：【炮制方法】处方用名有芥子、白芥子、炒芥子、炒白芥子。①芥子：取原材料，去净杂质，用时捣碎。②炒芥子：取净芥子，置炒制容器内，用文火加热，炒至淡黄色至深黄色（炒白芥子）或深黄色至棕褐色（炒黄芥子），有爆鸣声，断面浅黄色，有香辣气时即可。用时捣碎。清炒法（单炒法）根据加热程度不同分为炒黄、炒焦、和炒炭。（1）炒黄是将净制或切制过的药物，置炒制容器内，用文火或中火加热，并不断翻动或转动，使药物表面呈黄色或颜色加深，或发泡鼓起，或爆裂，并逸出固有气味的方法。常用炒黄法炮制的中药有牛蒡子、芥子、王不留行、莱菔子、苍耳子等。（2）炒焦是将净选或切制后的药物，置炒制容器内，用中火或武火加热，炒至药物表面呈焦黄或焦褐色，内部颜色加深，并具有焦香气味。炒焦的目的：主要是增强药物消食健脾的功效或减少药物的刺激性，如山楂、栀子等。（3）炒炭是将净选或切制后的药物，置炒制容器内，用武火或中火加热，炒至药物表面焦黑色或焦褐色，内部呈棕褐色或棕黄色。炒炭的目的：经炒炭炮制后可使药物增强或产生止血、止泻作用。常用炒炭法炮制的中药有大蓟（C错）、蒲黄（B错）、荆芥（D错）等。枳壳（E错）常用麸炒法炮制。麸炒是将净制或切制后的药物用麦麸熏炒的方法。麸炒的目的：①增强疗效，如山药、白术、芡实等。②缓和药性，如苍术、枳实、薏苡仁等。③矫臭矫味，如僵蚕等。